甘草具有的功效是
A. 补气燥湿
B. 益气养阴
C. 生津养血
D. 托毒生肌
E. 润肺止咳

正确答案：E。润肺止咳

解析：该题考查甘草的功效，属记忆内容。甘草味甘，性平；入心、肺、脾、胃经，具有补气益气，润肺止咳，缓急止痛，缓和药性的功效（E对ABCD错）。